男。63岁。皮肤黏膜散在出血点10天。既往肝硬化病史多年。给于输注新鲜冰冻血浆治疗。输注开始后20分钟，患者出现皮肤瘙痒、荨麻疹表现。此时正确的处理措施是
A. 停止输注
B. 换一袋血浆输注
C. 减慢输注速度，并给于抗组胺药物治疗
D. 减慢输注速度，并给于肾上腺素治疗
E. 继续输注，不做任何处理

正确答案：C。减慢输注速度，并给于抗组胺药物治疗

解析：患者给予输注新鲜冰冻血浆治疗，输血开始后20分钟，出现皮肤瘙痒、荨麻疹表现，发生过敏反应，此时可采取需减慢输注速度，并给于抗组胺药物治疗（C对D错）缓解。停止输血（A错）多适用于过敏反应重者（全身皮疹、喉头水肿、支气管痉挛、过敏性休克等）。换一袋血浆输注（B错）不能避免过敏反应的发生。继续输注，不做任何处理（E错）可能发生更严的过敏反应。